原发性高血压时细动脉可逆性改变是
A. 血管腔狭窄
B. 血管壁平滑肌萎缩
C. 内膜下蛋白物沉积
D. 血管壁纤维化
E. 血管痉挛

正确答案：E。血管痉挛

解析：原发性高血压1.功能紊乱期：全身细小动脉间歇性痉挛收缩（E对）、血压升高，因动脉无器质性病变，痉挛缓解后血压可恢复正常。2.动脉病变期：（1）细动脉硬化：高血压病的主要病变特征，表现为细小动脉玻璃样变。由于细动脉长期痉挛，加之血管内皮细胞受长期的高血压刺激，使内皮细胞及基底膜受损，内皮细胞间隙扩大，通透性增强，血浆蛋白渗入血管壁中。同时SMC分泌大量细胞外基质，SMC因缺氧而变性、坏死（B错），遂使血管壁逐渐由血浆蛋白、细胞外基质和坏死SMC产生的修复性胶原纤维及蛋白多糖所代替（D错），正常管壁结构消失，逐渐凝固成红染无结构均质的玻璃样物质，致细动脉壁增厚，管腔缩小（A错）甚至闭塞。